男，56岁。反复咳嗽30年伴间断咯血。发作时使用“头孢菌素”及止血治疗可缓解。查体：左下肺可闻及湿性啰音。胸部X线片示左下肺纹理增粗、紊乱。为明确咯血的病因，宜首先采取的检查是
A. 支气管镜
B. 胸部高分辨CT
C. 痰找癌细胞
D. 肺通气/灌注扫描
E. 支气管动脉造影

正确答案：B。胸部高分辨CT

解析：患者为中年男性，反复咳嗽伴间断咯血30年（为支气管扩张的典型表现），左下肺可闻及湿性啰音，“头孢菌素”治疗有效提示为支气管细菌性肺炎，胸部X线片左下肺纹理增粗、紊乱，初步诊断为支气管扩张。支扩的临床表现主要为慢性咳嗽、咯大量脓痰和（或）反复咯血，胸部X线平片检查时，囊状支气管扩张的气道表现为显著的囊腔，腔内可存在气液平面，囊腔内无气液平面时，很难与大疱性肺气肿或严重肺间质病变的蜂窝肺鉴别。高分辨CT（HRCT）（B对）能清楚地显示扩张的支气管，目前已取代支气管造影（E错）成为首选的明确诊断的检查措施。支气管镜检查（A错）是支扩的辅助检查，当支气管呈局灶性且位于段支气管以上时，可发现弹坑样改变，但不能明确诊断。痰找癌细胞（C错）一般用于肺癌的确诊。肺通气/灌注扫描（D错）主要用于肺栓塞的辅助诊断。